女，35岁。支气管哮喘史20年，近2周来出现活动耐力下降。该患者最重要的治疗措施是规律使用
A. 糖皮质激素气雾剂
B. 长效β₂受体激动剂
C. 短效β₂受体激动剂
D. 联合吸入糖皮质激素和长效β₂受体激动剂
E. 胆碱能受体抑制剂

正确答案：D。联合吸入糖皮质激素和长效β₂受体激动剂

解析：患者有哮喘病史，近期活动耐力下降，但并未出现急性发作，应选用长期控制性药物。当前最常用的长期控制性药物为联合吸入糖皮质激素和长效β₂受体激动剂（D对）。糖皮质激素主要作用为抗炎，β₂受体激动剂主要作用为解痉，两者需联合使用（AB错）。短效β₂受体激动剂（C错）能有效缓解支气管痉挛，为急性哮喘发作的首选用药。胆碱能受体抑制剂抑制胆碱能神经紧张，也可缓解支气管的痉挛，效果较β₂受体激动剂差。短效胆碱能受体抑制剂（E错）常与β₂受体激动剂联合应用与急性哮喘，长效胆碱能受体抑制剂主要用于哮喘合并慢阻肺以及慢阻肺患者的长期治疗。